咬肌浅层的起始部位为
A. 上颌骨颧突及颧弓下缘的前2/3
B. 颞窝及颞深筋膜深面
C. 腭骨锥突及上颌结节
D. 蝶骨大翼的颞下面，颞下嵴及翼外板的外侧面
E. 上颌骨的眶下缘及额突

正确答案：A。上颌骨颧突及颧弓下缘的前2/3

解析：本题考查咀嚼肌、颈部肌及口颌系统肌链。咬肌浅层的起始部位为上颌骨颧突及颧弓下缘的前2/3（A对）。咬肌浅层浅层最大，以一厚腱膜起于颧骨的上颌突和颧弓下缘的前2/3，向下后方走行，止于下颌角和下颌支外面的下半部；中层起于颧弓前2/3的深面及后1/3的下缘，止于下颌支的中份；深层起于颧弓深面，止于下颌支的上部和喙突。功能：上提下颌骨并使下颌骨微向前伸，也参与下颌侧方运动。